关于尖牙的临床应用解剖的说法错误的是
A. 位于口角处，能够支撑口角
B. 若缺失，则口角塌陷，对面容影响较大
C. 发生龋齿机会多
D. 留存时间最久的牙齿
E. 口腔修复时多用作基牙

正确答案：C。发生龋齿机会多

解析：本题考查上下颌前牙的外形及临床应用解剖。尖牙的应用解剖：①尖牙位于口角处，其根长大粗壮，起支撑口角的作用（A对）。如缺失则口角塌陷，对面容影响较大（B对）；②牙冠各面光滑，自洁作用良好，发生龋齿的机会较少（C错，为本题正确答案）；③因其牙根长、稳固，通常是口内留存时间最长的牙（D对）。修复时多用作基牙（E对）；④上颌尖牙牙根为圆锥形单根较直，拔除时可用旋转力。